三羧酸循环中的草酰乙酸来源于
A. 糖原合成
B. 尿酸合成
C. 糖原分解
D. 丙酮酸羧化
E. 酮体生成

正确答案：D。丙酮酸羧化

解析：糖原合成（A错）是体内葡萄糖合成糖原存贮的过程，并不产生草酰乙酸。尿酸合成（B错）是嘌呤代谢的终产物，没有草酰乙酸的合成。糖原分解（C错）是体内糖原分解为葡萄糖的补充血糖的过程。酮体生成（E错）是由乙酰辅酶A合成酮体的过程，不涉及三羧酸循环中的草酰乙酸。丙酮酸羧化（D对）是三羧酸循环中的草酰乙酸的来源之一。